女，20岁。咳嗽、胸闷1周。查体：右下肺呼吸音消失。胸部X线片示右侧大量胸腔积液。该患者肺通气功能检查最不可能出现的结果是
A. 一秒量下降
B. 残气量下降
C. 肺总量下降
D. 用力肺活量下降
E. 一秒率下降

正确答案：E。一秒率下降

解析：患者出现咳嗽、胸闷、右下肺呼吸音消失（为胸腔积液的典型表现和体征），且胸部X线片示右侧大量胸腔积液，根据其典型表现和辅助检查，可以诊断为胸腔积液。胸腔积液属于限制性通气功能障碍性疾病，其肺通气功能检查可出现限制性通气功能障碍的表现，比如用力肺活量减低（D对），一秒量正常或减低（A对）、一秒率（一秒量/用力肺活量）正常或增加（E错，为本题正确答案）、残气量下降（B对）、肺总量减低（C对）。